原发免疫性血小板减少症较少出现
A. 肌肉血肿
B. 鼻出血
C. 月经过多
D. 口腔黏膜出血
E. 皮肤淤点

正确答案：A。肌肉血肿

解析：原发免疫性血小板减少症较少出现肌肉血肿（A错为本题正确答案）。原发免疫性血小板减少症（ITP）既往也称为特发性血小板减少性紫癫，是一种复杂的多种机制共同参与的获得性自身免疫性疾病，一般起病隐袭，常表现为反复的皮肤黏膜出血如淤点（E对）、紫癫、淤斑及外伤后止血不易等，鼻出血（B对）、牙根出血、月经过多（C对）亦很常见。严重内脏出血较少见，查体可发现皮肤紫癫或瘀斑，以四肢远侧端多见，黏膜出血以鼻出血、牙龈出血或口腔黏膜血疱（D对）多见。